青春期最容易出现的问题是
A. 营养问题
B. 心理问题
C. 学习问题
D. 人格问题
E. 疾病

正确答案：B。心理问题

解析：本题考查青春期的特点。青少年生理发育已较成熟，而心理和社会适应能力发展相对滞后，易产生青春期复杂的心理卫生问题（B对ACDE错）。